适用于老年高血压并发心力衰竭患者的药物是
A. 缬沙坦
B. 美托洛尔
C. 非洛地平
D. 氢氯噻嗪
E. 赖诺普利

正确答案：D。氢氯噻嗪

解析：本题考查抗高血压药。适用于老年高血压并发心力衰竭患者的药物是氢氯噻嗪（D对）。氢氯噻嗪为噻嗪类利尿剂，适用千老年高血压、单纯收缩期高血压或伴心力衰竭患者，也是难治性高血压
的基础控压药物之一。缬沙坦（A错）为ARB类降压药，适用于伴左心室肥厚、心力衰竭、糖尿病肾病、冠心病、代谢综合征以及不能耐受ACEI的患者。美托洛尔（B错）属于β-受体阻断剂，剂尤其适用于交感神经活性增高以及高动力状态的高血压患者，如伴有快速型心律失常、冠心病、慢性心力衰竭的患者。非洛地平（C错）属于二氢吡啶类钙通道阻滞剂，一般与其他抗压药物联用，适用于老年高血压、单纯收缩压高血压、伴稳定性心绞痛、冠状动脉或颈动脉粥样硬化及周围血管病患者。赖诺普利（E错）为ACEI类降压药，适用于伴慢性心力衰竭、心肌梗死后心功能不
全、心房颤动、糖尿病肾病、慢性肾脏病、代谢综合征、蛋白尿或微量白蛋白尿的患者。